与硫酸亚铁合用，可减少铁的吸收
A. 叶酸
B. 苄丝肼
C. 克拉维酸钾
D. 奥美拉唑
E. 维生素C

正确答案：D。奥美拉唑

解析：本题考查铁剂的使用。与硫酸亚铁合用，可减少铁的吸收的是奥美拉唑（D对）。奥美拉唑属于质子泵拮抗剂，影响三价铁转化为二价铁，避免长期服用。叶酸（A错）用于治疗巨幼细胞性贫血。苄丝肼（B错）为芳香氨基酸脱羧酶抑制剂。克拉维酸钾（C错）与阿莫西林合用，可保护其免受开环破坏，抗菌活性增强。维生素C（E错）可以促进硫酸亚铁吸收。